引起我国雨水洪水型钩端螺旋体病的主要钩体群是
A. 七日群
B. 秋季群
C. 犬群
D. 黄疸出血群
E. 波摩那群

正确答案：E。波摩那群

解析：钩体的抗原结构复杂，我国已知有19群，74型，并有新群不断发现，常见的流行群是黄疸出血群、波摩那群、犬群（C错）、流感伤寒群、澳洲群、秋季群（B错）、七日群（A错）和爪哇群。雨水洪水型钩端螺旋体病的主要钩体群是波摩那群（E对），黄疸出血群（D错）毒力最强。